青春期保健
A. 保健的原则是对胎儿有利因素要保证，不利因素要尽量避免和减少
B. 主要保健重点是清理呼吸道，建立呼吸，保温，预防脐带断端、眼和皮肤感染，母乳喂养等
C. 约为10年，是身体和智力发展很快的时期。要加强营养，合理营养，避免儿童期肥胖的发生。避免女童发生外阴阴道炎
D. 是从儿童期末到性成熟期之间的一段生命时期，在此时期内身体和心理发生巨大的变化
E. 是妇女一生中生育和劳动生产的鼎盛时期

正确答案：D。是从儿童期末到性成熟期之间的一段生命时期，在此时期内身体和心理发生巨大的变化

解析：本题考查青春期保健的相关内容。青春期是从儿童期末到性成熟期之间的一段生命时期，是儿童到成人的转变期，处于此时期内的青少年女性身体和心理发生巨大的变化（D对ABCE错）。